男，34岁。5日前施工时右下肢被石板砸伤，已清创缝合，患者突然出现右下肢胀裂感剧痛，伤口周围皮肤变黑，伤口裂开，肌肉呈熟肉样，其周围有捻发音，渗出物恶臭。患者应该采用何种药物
A. 青霉素
B. 甲硝唑
C. 卡那霉素
D. 红霉素
E. 庆大霉素

正确答案：A。青霉素

解析：男，34岁。5日前施工时右下肢被石板砸伤，已清创缝合（创造了无氧环境），患者突然出现右下肢胀裂感剧痛，伤口周围皮肤变黑，伤口裂开，肌肉呈熟肉样（提示由于局部张力，皮肤受压发白），其周围有捻发音，渗出物恶臭（有硫化氢），综上考虑为气性坏疽，药物首选青霉素（A对），常见产气荚膜梭菌中对青霉素大多敏感。